能生风动血的邪气是
A. 风
B. 暑
C. 火热
D. 湿
E. 疫疠

正确答案：C。火热

解析：本题考查的是火邪的性质及致病特点。能生风动血的邪气是火热（C对）。火邪的性质及致病特点：（1）火热为阳邪，其性炎上；（2）火易伤津耗气；（3）火热易生风动血；（4）火热易发肿疡。风（A错）邪的性质及致病特点：（1）风为阳邪，其性开泄，易袭阳位；（2）风邪善行而数变；（3）风为百病之长。暑（B错）邪的性质及致病特点：（1）暑为阳邪，其性炎热；（2）暑性升散，耗气伤津；（3）暑多挟湿。湿（D错）邪的性质及致病特点：（1）湿为阴邪，易阻遏气机，损伤阳气；（2）湿性重浊；（3）湿性黏滞；（4）湿性趋下，易伤阴位。疫疠（E错）邪气：即疠气，是一类具有强烈传染性的外感致病邪气，又称“戾气”“异气”“毒气”“乖戾之气”等。疠气的致病特点：发病急骤、病情较重；一气一病、症状相似；传染性强、易于流行。